饭店的碗筷每次用后都进行消毒，该措施属于
A. 终末消毒
B. 经常性消毒
C. 随时消毒
D. 预防性消毒
E. 化学消毒

正确答案：D。预防性消毒

解析：本题考查预防性消毒。预防性消毒是指在没有发现明确传染源的情况下，对可能被传染病病原体污染的场所和物品进行消毒。如饭店的碗筷每次用后都进行消毒属于预防性消毒（D对ABCE错）。